男性，65岁。因声音嘶哑、反应迟缓、浮肿入院，诊断为慢性淋巴性甲状腺炎、甲减，有粘液性水肿、心包积液。经左旋甲状腺素钠（L-T₄）每日25μg起始、逐渐递增剂量治疗后，上述症状、体征已基本消失。调整L-T4剂量是依据
A. TSH
B. TT₃
C. TT₄
D. FT₃
E. FT₄

正确答案：A。TSH

解析：甲减的治疗目标是甲减的症状和体征消失、血清TSH、TT₄、FT₄水平达到正常，左旋甲状腺素剂量调整的依据是下丘脑-垂体-甲状腺轴的平衡，由于TSH变化最敏感，因此常以血TSH（A对）水平作为调整剂量的依据。